⊥Ⅳ表示
A. 右上颌第1乳磨牙
B. 右上颌第1前磨牙
C. 左上颌第1乳磨牙
D. 左上颌第2乳磨牙
E. 无

正确答案：C。左上颌第1乳磨牙

解析：第1乳磨牙用Ⅳ表示，第2乳磨牙用Ⅴ表示(D错)，⊥表示在图表右上象限，即左上颌(AB错)，所以⊥Ⅳ表示左上颌第1乳磨牙(C对)。